频发的周期性麻痹应选的治疗是
A. 胸腺摘除
B. 乙酰唑胺
C. 强的松
D. 吡啶斯的明
E. 卡马西平

正确答案：B。乙酰唑胺

解析：周期性麻痹现称周期性瘫痪，是一组以反复发作的骨骼肌弛缓性瘫痪为特征的肌病，与钾代谢异常有关。肌无力可持续数小时或数周，发作间期完全正常，根据发作时血清钾的浓度，可分为低钾型、高钾型和正常型三类，临床以低钾型多见（P370）。对于频发的周期性瘫痪可以使用乙酰唑胺（B对），乙酰唑胺对各型周期性麻痹均有预防作用，且可使发作间歇性持续存在的肌力减弱获得改善。胸腺摘除（A错）为重症肌无力的胸腺治疗。强的松（C错）可用于预防正常钾型周期性麻痹。吡啶斯的明（D错）属于胆碱酯酶抑制剂，临床主要用于治疗青光眼，也可用于重症肌无力的治疗。卡马西平（E错）为抗癫痫药，用于癫痫治疗。